关于三明治技术下列说法正确的是
A. 玻璃离子与牙体硬组织靠机械嵌合
B. 玻璃离子表面应酸蚀
C. 玻璃离子与复合树脂的结合方式为化学结合
D. 降低了复合树脂与洞壁的密合性
E. 以上都对

正确答案：B。玻璃离子表面应酸蚀

解析：本题考查三明治技术。关于三明治技术下列说法正确的是玻璃离子表面应酸蚀（B对）。玻璃离子上覆盖复合树脂之前需要酸蚀，酸蚀后玻璃离子表面变的粗糙，既增加了粘结面积又增大了复合树脂与玻璃离子的机械嵌合作用，使两者之间的结合力增大。玻璃离子通过三方面的作用与牙齿粘结：1.聚丙烯酸分子链上的羧基与牙硬组织中的Ca²⁺的螯合作用；2.聚丙烯酸分子链上的羧基与牙本质中的胶原蛋白形成氢键；3.机械嵌合作用；故玻璃离子和牙体硬组织主要通过化学固位和机械嵌合两种方式固位（A错）。玻璃离子与复合树脂的结合方式中存在机械嵌合作用（C错）。玻璃离子体能直接与牙本质和复合树脂粘结，可以更好地贴合无釉质结构的龈壁，有效地封闭边缘，同时玻璃离子具有与牙本质接近的弹性模量，可以缓冲复合树脂聚合产生的收缩应力，三明治技术可以增加树脂与洞壁的密合性（D错）。